患者，男，63岁，2型糖尿病病史20年，现服用二甲双胍0.5g，一日3次，阿卡波糖0.1g，一日3次。罗格列酮4mg，一日1次，既往高血压病史5年，冠心病病史5年，心功能I级，轻度肾功能不全，长期服用贝那普利、阿司匹林。患者在行冠脉血管造影检查后，突发心慌、饥饿，血糖3.8mmol/L，首选进食
A. 蔗糖
B. 馒头
C. 葡萄糖
D. 无糖饼干
E. 麦芽糖

正确答案：C。葡萄糖

解析：本题考查口服降糖药的用药监护。饮用葡萄糖（C对）水或服糖果，可缓解糖尿病患者出现的低血糖症状。